桂枝汤中配伍炙甘草的主要用意是
A. 益气补虚
B. 扶正祛邪
C. 缓峻护正
D. 化痰止咳
E. 发汗祛湿

正确答案：B。扶正祛邪

解析：桂枝汤的功用为解肌发表，调和营卫。炙甘草甘，平；归心、肺、脾、胃经。可补脾益气，祛痰止咳，缓急止痛，清热解毒，调和诸药。桂枝汤中炙甘草调和药性，合桂枝辛甘化阳以实卫，合芍药酸甘化阴以益营，所谓益营合实卫都是扶正，扶正则可祛邪外出（B对）。